下列关于甲状腺功能减退患者激素替代治疗的说法，错误的是
A. 需要终身服药
B. 服用过量可能出现甲状腺功能亢进症状
C. 左甲状腺素应于早餐前半小时空腹服用
D. 妊娠期父母必须联合使用丙硫氧嘧啶
E. 治疗目标是将TSH和甲状腺激素水平恢复道正常范围

正确答案：D。妊娠期父母必须联合使用丙硫氧嘧啶

解析：本题考查甲状腺功能减退患者激素替代治疗。妊娠期妇女必须联合使用丙硫氧嘧啶（D错，为本题正确答案）说法错误。丙硫氧嘧啶能通过胎盘作用于胎儿，降低胎儿甲状腺功能，影响胎儿发育，因此妊娠期间不宜与抗甲状腺药物联用。左甲状腺素（L-T₄）治疗目标是将血清TSH和甲状腺激素水平恢复至正常水平（E对），需要终生服药（A对）。左甲状腺素应于早餐前半小时空腹食用（C对）。